行于下肢外侧中线的经脉是
A. 足少阳胆经
B. 足少阴肾经
C. 足厥阴肝经
D. 足阳明胃经
E. 足太阴脾经

正确答案：A。足少阳胆经

解析：该题考查十二经脉的分布规律。十二经脉左右对称的分布于头面、躯干和四肢，纵贯全身。上肢内侧为手三阴经，从前到后依次为手太阴肺经，手厥阴心包经，手少阴心经，上肢外侧为手三阳经，从前到后依次为手阳明大肠经，手少阳三焦经，手太阳小肠经。下肢外侧为足三阳经，从前到后依次为足阳明胃经，足少阳胆经，足太阳膀胱经。下肢内侧为足三阴经，在足内踝上8寸以下为厥阴在前、太阴在中、少阴在后，至内踝上8寸以上，太阴交出于厥阴之前（A对BCDE错）。记忆：阳经，前中后：阳少太。阴经，前中后：太厥少。